欲研究新药“胃痛颗粒”治疗胃病的疗效，在某医院选择了100例胃炎和胃溃疡患者，随机分到试验组和对照组。试验组服用“胃痛颗粒”治疗，对照组服用公认有效的“胃苏冲剂”。这种对照属于
A. 空白对照
B. 安慰剂对照
C. 实验对照
D. 标准对照
E. 自身对照

正确答案：D。标准对照